某男，89岁。因倒开水不慎左手背轻度烫伤肿痛溃烂。宜选用的成药是
A. 京万红软膏
B. 紫草膏
C. 如意金黄散
D. 拔毒生肌散
E. 生肌玉红膏

正确答案：A。京万红软膏

解析：本题考查的是京万红软膏的主治。因倒开水不慎左手背轻度烫伤肿痛溃烂。宜选用的成药是京万红软膏（A对）。京万红软膏：【主治】轻度水、火烫伤，疮疡肿痛，创面溃烂。紫草膏（B错）：【主治】热毒蕴结所致的溃疡，症见疮面疼痛、疮色鲜活、脓腐将尽。如意金黄散（C错）：【主治】热毒瘀滞肌肤所致的疮疡肿痛、丹毒流注，症见肌肤红、肿、热、痛，亦可用于跌打损伤。拔毒生肌散（D错）：【主治】热毒内蕴所致的溃疡，症见疮面脓液稠厚、腐肉未脱、久不生肌。生肌玉红膏（E错）：【主治】热毒壅盛所致的疮疡，症见疮面色鲜、脓腐将尽、或久不收口；亦用于乳痈。